治疗军团菌感染的首选药物是
A. 青霉素G
B. 氟康唑
C. 四环素
D. 红霉素
E. 氯霉素

正确答案：D。红霉素